糖皮质激素的禁忌证包括
A. 活动性消化性溃疡
B. 严重精神病或癫痫
C. 严重2型糖尿病
D. 未能控制的细菌、病毒或真菌感染
E. 系统性红斑狼疮

正确答案：A、B、C、D。活动性消化性溃疡；严重精神病或癫痫；严重2型糖尿病；未能控制的细菌、病毒或真菌感染

解析：本题考查糖皮质激素的禁忌证。糖皮质激素的禁忌证：①严重精神病或癫痫病史者（B对）、活动性消化性溃疡病（A对）或新近胃肠吻合术者、骨折患者、创伤修复期患者、角膜溃疡者、肾上腺皮质功能亢进者、严重高血压、糖尿病患者（C对）。②妊娠早期妇女。③抗菌药物不能控制的水痘、真菌感染者。④未能控制的结核、细菌和病毒感染者（D对）。系统性红斑狼疮（E错）是糖皮质激素的适应证。